IgA分为两类，分别为
A. 血清型IgA和分泌型IgA
B. 体液型IgA和分泌型IgA
C. 血清型IgA和合成型IgA
D. 体液型IgA和合成型IgA
E. 单一型IgA和复杂型IgA

正确答案：A。血清型IgA和分泌型IgA

解析：IgA有血清型IgA和分泌型IgA两类。掌握“各类球蛋白的特性和功能”知识点。